随机临床试验的主要优点是
A. 避免了观察者偏倚
B. 可证实本身是合乎道德的
C. 排除了参加者对不同治疗组群的自我选择
D. 登记了有代表性的病人
E. 导出了可适用于其他病人的结果

正确答案：C。排除了参加者对不同治疗组群的自我选择

解析：本题考查随机临床试验的特点。临床试验通常具有如下特点：①以病人作为研究对象；②研究多在医院进行；③多为治疗性试验；④研究对象应尽可能在基线特征方面一致；⑤随机分配治疗措施，并尽可能做到分配方案的隐藏，对分配的治疗不依从，应当测最其程度与原因；⑥尽可能采用盲法；⑦如果对于所研究的疾病没有接受的疗法，可以应用安慰剂作为比较。根据临床试验的特点可以推断出，随机化的分组和相近的基线资料排除了参加者对不同治疗组群的自我选择（C对ABDE错），减少了试验的偏倚。